《根据疫苗流通和预防接种管理条例》，接种单位发现质量可疑疫苗相关的处理措施，错误的是
A. 发现单位应立即向所在地卫生主管部门和监督管理部门报告
B. 发现单位应当立即停止接种、分发、供应，退回原供应单位并做好记录
C. 卫生主管部门应立即采取必要的应急处置措施，同时向上级卫生主管部门报告
D. 药品监督管理部门应当对质量可疑疫苗采取查封，扣押等措施

正确答案：B。发现单位应当立即停止接种、分发、供应，退回原供应单位并做好记录

解析：本题考查《疫苗流通和预防接种管理条例》。《根据疫苗流通和预防接种管理条例》，接种单位发现质量可疑疫苗，应当立即停止接种、分发、供应、销售，并立即向所在地的县级人民政府卫生主管部门和药品监督管理部门报告，不得自行处理（B错，为本题正确答案）。《疫苗流通和预防接种管理条例》第六章监督管理第四十九条：药品监督管理部门在监督检查中，对有证据证明可能危害人体健康的疫苗及其有关材料可以采取查封、扣押的措施，并在7日内作出处理决定；疫苗需要检验的，应当自检验报告书发出之日起15日内作出处理决定。疾病预防控制机构、接种单位、疫苗生产企业发现假劣或者质量可疑的疫苗，应当立即停止接种、分发、供应、销售，并立即向所在地的县级人民政府卫生主管部门和药品监督管理部门报告（A对），不得自行处理。接到报告的卫生主管部门应当立即组织疾病预防控制机构和接种单位采取必要的应急处置措施，同时向上级卫生主管部门报告（C对）；接到报告的药品监督管理部门应当对假劣或者质量可疑的疫苗依法采取查封、扣押等措施（D对）。